虎杖中含有的蒽醌类化合物是
A. 7-羟基黄酮
B. 七叶内酯
C. 大黄酸
D. 苦参碱
E. 葡萄糖醛酸

正确答案：C。大黄酸

解析：本题考查虎杖的主要化学成分。虎杖中含有的蒽醌类化合物是大黄酸（C对）。虎杖主要含有蒽醌类化合物，此外还含有二苯乙烯类、黄酮类、水溶性多糖和鞣质等成分。蒽醌类成分包括大黄素、大黄酚、大黄酸等。秦皮的原植物主要有两种，即木犀科植物大叶白蜡树及白蜡树，大叶白蜡树皮中主要含七叶内酯（B错）（秦皮乙素）和七叶苷（秦皮甲素），而白蜡树皮中主要含白蜡素和七叶内酯以及白蜡树苷。苦参所含主要生物碱是苦参碱（D错）和氧化苦参碱，《中国药典》以其为指标成分对苦参进行鉴别和含量测定，含量测定要求苦参碱和氧化苦参碱总量不得少于1.2%。黄芩经过蒸制或沸水煮既可杀酶保苷，防止将黄芩中的黄芩苷和汉黄芩苷酶分解成葡萄糖醛酸（E错）和黄芩素与汉黄芩素。